可使葡萄糖醛酸转移酶缺乏的新生儿出现溶血现象的药物是
A. 氯霉素
B. 新生霉素
C. 磺胺嘧啶
D. 葡萄糖
E. 苯巴比妥

正确答案：C。磺胺嘧啶

解析：本题考查磺胺嘧啶的不良反应。磺胺嘧啶（C对）的不良反应有过敏反应、中性粒细胞减少或缺乏症、血小板减少、再生障碍性贫血、溶血性贫血、血红蛋白尿、高胆红素血症、新生儿核黄疸等。氯霉素（A错）的主要不良反应是抑制骨髓造血机能，新生儿与早产儿剂量过大可发生灰婴综合征。新生霉素（B错）主要用于耐药性金葡菌引起的感染，皮疹为最常见的过敏反应。葡萄糖（D错）属于供能物质，与题意无关。新生儿使用苯巴比妥（E错）易中毒，急性中毒症状为昏睡，进而呼吸浅表，通气量大减，最后因呼吸衰竭而死亡。